基底细胞腺瘤发生于小唾液腺时，尤其多见于
A. 下唇
B. 腭部
C. 舌部
D. 上唇
E. 颊部

正确答案：D。上唇

解析：基底细胞腺瘤发生于小唾液腺，尤其上唇多见。掌握“基底细胞腺瘤及恶性多形性腺瘤”知识点。